患者，20岁，1年前右上1外伤，检查：右上1切角缺损，温度测试正常，牙体无不适，最佳的修复方式为
A. 嵌体
B. 部分冠
C. 铸造金属全冠
D. 锤造金属全冠
E. 塑料全冠

正确答案：A。嵌体

解析：本题考查牙体缺损修复体固位及适应、禁忌证。嵌体（A对）的适应证①各种牙体缺损已涉及牙尖、切角、边缘嵴以及面，而不能使用一般材料充填修复者。②因牙体缺损的邻接不良或食物嵌塞严重，需恢复邻面接触点者。③牙体虽有缺损，但仍存在有较大体积的健康牙体组织，可以为嵌体提供足够抗力者。